拔牙后出血是指拔牙后至少多长时间仍有明显创口出血
A. 2小时
B. 30分钟
C. 10分钟
D. 60分钟
E. 24小时

正确答案：B。30分钟

解析：本题考查拔牙后出血。拔牙后出血是指拔牙后至少30分钟（B对）仍有明显创口出血。由于根尖血管和牙周组织的撕裂，牙槽窝内出血，拔牙后15～30min出血停止，形成血凝块封闭创口。拔牙后出血可分为原发性出血和继发性出血。原发性出血为拔牙后当日，取出压迫的棉卷后，牙槽窝出血未止，仍有活动性出血。继发性出血是拔牙出血当时已停止，以后因创口感染等其他原因引起的出血。拔牙后出血常因牙槽窝内残留炎性肉芽组织，软组织撕裂，牙槽突骨折，牙槽内小血管破裂等局部因素，血块因保护不良而脱落，也会引起出血，还有少数全身因素。故拔牙后应观察30min以上，确认无出血后，方允许患者离开。